下述正常人摄取糖类过多时的几种代谢途径中，哪一项是错误的
A. 糖转变为甘油
B. 糖转变为蛋白质
C. 糖转变为脂肪酸
D. 糖氧化分解成CO₂，H₂O
E. 糖转变成糖原

正确答案：B。糖转变为蛋白质